五聚体IgM一般只有几个结合点可结合抗原
A. 1个
B. 2个
C. 4个
D. 5个
E. 10个

正确答案：D。5个